亚油酸含量最高的部位是
A. 胚
B. 胚乳
C. 谷皮
D. 全谷粒
E. 糊粉层

正确答案：A。胚